男性患者，75岁。突然晕厥，查体：神志淡漠，血压85/65mmHg，心率38次/分，四肢湿冷，心电图示急性下壁心肌梗死，Ⅲ度房室传导阻滞。首选治疗是
A. 异丙肾上腺素静脉滴注
B. 阿托品静脉滴注
C. 安装临时心脏起搏器
D. 安装永久性心脏起搏器
E. 肾上腺皮质激素

正确答案：C。安装临时心脏起搏器

解析：安置临时起搏器适应证：①高度或完全传导阻滞且逸搏心律过缓。②操作过程中或急性心肌梗死，药物中毒、严重感染等危急情况下出现危及生命的缓慢性心律失常。患者为Ⅲ度房室传导阻滞，心率减慢（平均在75次/分左右，一般在60～100次/分之间），急性下壁心肌梗死，出现晕厥休克，血压降低（国家权威机构发布正常血压：收缩压＜130mmHg，舒张压＜85mmHg。理想血压：收缩压＜120mmHg，舒张压＜80mmHg），四肢湿冷，情况危急，需要安装临时起搏器（C对）。控制休克使用升压药物时当大剂量多巴胺无效时，也可静脉滴注去甲肾上腺素。对于心肌梗死引起的心源性休克，患者一般存在心脏收缩力不足的问题，心脏泵血功能下降的问题，使用异丙肾上腺素引起周围血管扩张，使回心血量减少，加重脑肾等重要器官损伤，故禁用（A错）。对缓慢性心律失常可用0.52017U3ZXY2017U3-1g阿托品静脉滴注。阿托品的适应症为Ⅰ度房室传导阻滞（B错）。严重缓慢性心律失常，永久心脏起搏是唯一有效而可靠的治疗方法。安置指征为：①伴有临床症状的任何水平的完全或高度房室传导阻滞。②束支2017U3ZXY2017U3-分支水平阻滞，间歇Ⅱ度Ⅱ型房室传导阻滞且有症状者；在观察过程中阻滞程度进展，HV间期大于100ms者，可无症状。③病窦综合征或房室传导阻滞，心室率低于50次/分，有明显临床症状或间歇发生，心室率＜40次/分：或有长达3秒的RR间隔，可无症状。④颈动脉窦过敏引起的心率减慢，心率或RR间隔达到上述标准，伴有明显症状者（D错）。肾上腺皮质激素治疗心源性休克，须结合病因治疗（E错）。